某病发病率水平超过该地一定历史条件下的流行水平，且迅速蔓延，跨省、国家、洲界，此描述属于何种流行强度
A. 散发
B. 暴发
C. 流行
D. 大流行
E. 大暴发

正确答案：D。大流行